“病人仰卧在躺椅上畅所欲言，治疗者在倾听和释问中解释病人的潜意识，情绪或幼年的特殊生活事件的方法”称为
A. 梦的分析
B. 自由联想
C. 系统脱敏
D. 厌恶疗法
E. 生物反馈

正确答案：B。自由联想

解析：自由联想（B对）是精神分析疗法的一种，在精神分析理论的指导下，病人仰卧在躺椅上畅所欲言，治疗者在倾听和释问中解释病人的潜意识、情绪或幼年的特殊生活事件，发现病人压抑在潜意识中的冲突，使病人领悟到心理问题的潜意识症结，让焦虑的情绪得到宣泄，从而使其能以现实的方式处理和适应各种情况。梦的分析（A错）也是精神分析疗法的一种，是治疗者让病人对梦的内容进行自由联想，发现梦中象征的真实含义，从而理解自己的潜意识冲突、症结及被压抑的愿望。系统脱敏、厌恶疗法和生物反馈都是行为疗法。系统脱敏（C错）是治疗师帮助患者建立与不良行为反应相对抗的松弛条件反射，然后在接触引起这种行为的条件刺激中，将习得的放松状态用于抑制焦虑反应，使不良行为逐渐消退（脱敏），最终使不良行为得到矫正。厌恶疗法（D错）是一种通过轻微的惩罚来消除适应不良行为的治疗方法。生物反馈疗法（E错）是指在电子仪器帮助下，将身体内部的生物电活动加以放大，放大后的机体电活动信息以视觉（如仪表读数）或听觉（加蜂鸣音）形式呈现出来，使患者得以了解自身的机体状态，并学会在一定程度上随意地控制和矫正不正常的生理变化。